劳动时人体所需的氧量取决于
A. 劳动强度
B. 劳动时间
C. 作业类型（动、静）
D. 习服程度
E. 动力定型程度

正确答案：A。劳动强度